患者腹部出现由左肋下向右进行的较强蠕动波，见于下列何种病变
A. 胃下垂
B. 胃扩张
C. 幽门梗阻
D. 胃癌
E. 急性胃炎

正确答案：C。幽门梗阻

解析：患者腹部出现由左肋下向右进行的较强蠕动波，见于幽门梗阻（C对）。蠕动波是由于胃肠道发生梗阻，梗阻近端的胃或肠段因饱满而隆起，进而显出各自的轮廓，并伴有该部位蠕动加强所导致；除腹壁菲薄的多产妇和极度消瘦的老人外，正常人腹部看不见蠕动波。当发生幽门梗阻时，胃的蠕动会增强，常可以看到由左肋下向右进行的较强蠕动波。但胃下垂（A错）、胃扩张（B错）、胃癌（D错）（无并发幽门梗阻时）和急性胃炎（E错）患者并不会引起明显的胃肠道梗阻，因此均不能看到胃蠕动波。